男，20岁，神志不清2小时入院，既往患1型糖尿病5年，长期皮下注射胰岛素，近3天因腹泻而停用。体检：血压70/50mmHg，皮肤中度失水征，呼吸深大，有烂苹果味，心率130次/分。最可能与诊断无关的检查是
A. 血气分析
B. 血电解质测定
C. 血糖
D. 尿糖、尿酮
E. 血培养

正确答案：E。血培养

解析：Ⅰ型糖尿病患者（易自发糖尿病酮症酸中毒），长期胰岛素治疗，近3天中断使用（诱因）后，呼吸深大（Kussmaul深大呼吸常提示酸中毒）、有烂苹果味（丙酮主要经呼吸道排出，提示血中丙酮含量增多），皮肤中度失水征、休克（BP70/50mmHg、P130次/分），神志不清2小时，最可能的诊断为糖尿病酮症酸中毒昏迷。怀疑糖尿病酮症酸中毒可能时，应立即查尿糖、尿酮（D对），同时抽血查血糖（C对）、血酮以初步诊断。还应检查血电解质（B对）、血气分析（A对）等进一步明确本病的发生，尚可评估病情，判断脱水与酸中毒的程度以指导治疗。血培养（E错，为本题的正确答案）主要用于血源性感染的诊断与病因诊断，本例患者无感染征象，因此不用血培养。